小儿上呼吸道感染常见病原体是
A. 肺炎双球菌
B. 金黄色葡萄球菌
C. 人肺炎支原体
D. 病毒
E. 真菌

正确答案：D。病毒